对于深龋窝洞，虽患者无自发痛，但有明显的激发痛，备洞过程及其敏感，首选的治疗措施是
A. 直接盖髓
B. 间接盖髓
C. 安抚治疗
D. 双层垫底充填
E. 根管治疗

正确答案：C。安抚治疗

解析：一些深龋患者，无自发痛，但有明显的激发痛，备洞过程及其敏感，这类患者应先作安抚治疗，待症状消除后再作进一步处理。掌握“深龋的治疗”知识点。